以上哪种类型的义齿适用于缺牙间隙小，缺隙两端均有稳固的基牙者
A. 金属铸造支架式义齿
B. 黏膜支持式义齿
C. 牙与黏膜混合支持式义齿
D. 胶连式义齿
E. 牙支持式义齿

正确答案：E。牙支持式义齿

解析：牙支持式义齿适用于少数牙缺失，或缺牙间隙小，缺隙两端均有基牙，且基牙稳固者。掌握“局部义齿类型，肯氏分类及模型观测”知识点。